1354-2009）中，根据大米的加工精度将大米分为一级、二级、三级和四级大米，其判断根据是
A. 加工后米胚残留程度
B. 加工后米粒表面和背沟残留皮层的程度
C. 加工后满足标准米（九五米）的程度
D. 加工后米胚残留以及米粒表面和背沟残留皮层的程度
E. 加工后米粒的光亮程度

正确答案：D。加工后米胚残留以及米粒表面和背沟残留皮层的程度

解析：本题考查大米加工精度的判断根据。在国家标准《大米》（GB 1354-2009）中，根据大米的加工精度将大米分为一级、二级、三级和四级大米，其判断根据是加工后米胚残留以及米粒表面和背沟残留皮层的程度（D对ABCE错）。